按国际抗癌联盟的TNM分期法，M0表示
A. 未发现远处转移
B. 有远处转移
C. 未发现原发肿瘤
D. 无法明确肿瘤体积
E. 未发现区域性淋巴结

正确答案：A。未发现远处转移

解析：乳腺癌的TNM分期（T：原发肿瘤，N：区域淋巴结，M：远处转移）中M0表示临床及影像学检查未见远处转移（A对）。M1：临床及影像学检查发现远处转移（B错），或组织学发现＞0.2mm的转移。T0无原发肿瘤证据（C错）。Tx：无法判断肿瘤体积（D错）。N0：区域淋巴结无转移（E错）。